属于长效M胆碱受体阻断剂的平喘药的是
A. 沙美特罗
B. 沙丁胺醇
C. 多索茶碱
D. 布地奈德
E. 噻托溴铵

正确答案：E。噻托溴铵

解析：本题考查噻托溴铵。属于长效M胆碱受体阻断剂的平喘药的是噻托溴铵（E对）。噻托溴铵属于长效M胆碱受体阻断剂的平喘药，适用于慢性阻塞性肺疾病的维持治疗，包括慢性支气管炎和肺气肿，伴随性呼吸困难的维持治疗及急性发作的预防。沙美特罗（A错）为长效β₂受体激动剂。沙丁胺醇（B错）为短效β₂受体激动剂。多索茶碱（C错）为黄嘌呤类平喘药。布地奈德（D错）为吸入型糖皮质激素。